出现大便隐血试验阳性，其上消化道出血量至少达到的数量是
A. 5～l0ml
B. 10ml
C. 20ml
D. 50ml
E. 60ml

正确答案：A。5～l0ml

解析：上消化道出血每日达到5～l0ml时，大便隐血试验阳性（A对）。 每日出血量超过50ml可出现黑便。胃内积血量超过250ml可引起呕血。